采收加工中需除去外皮的药材是
A. 板蓝根
B. 姜黄
C. 山药
D. 石菖蒲
E. 白芷

正确答案：C。山药

解析：本题考查的是山药的采收加工。采收加工中需除去外皮的药材是山药（C对）。山药【采收加工】冬季采挖，切去芦头，用竹刀刮去外皮，晒干，即为“毛山药”；或选择肥大顺直的毛山药，置清水中，浸至无干心，闷透，用木板搓成圆柱形，切齐两端，晒干，打光，习称“光山药”；或除去外皮，趁鲜切厚片，干燥，称为“山药片”。板蓝根（A错）【采收加工】秋季采挖，除去泥沙，晒干。姜黄（B错）【采收加工】冬季茎叶枯萎时采挖，洗净，煮或蒸至透心，晒干，除去须根。石菖蒲（D错）【采收加工】秋、冬两季挖取根茎，除去叶及须根，洗净泥土，晒干。白芷（E错）【采收加工】夏、秋间叶黄时，挖取根部，除去地上部分及须根，洗净泥土，晒干或烘干。